全子宫切除时无需切断的韧带是
A. 宫骶韧带
B. 卵巢固有韧带
C. 圆韧带
D. 主韧带
E. 骨盆漏斗韧带

正确答案：E。骨盆漏斗韧带

解析：全子宫切除时无需切断的韧带是骨盆漏斗韧带（E对），该韧带是阔韧带外1/3包绕卵巢动静脉形成的，是通过卵巢系膜和子宫相连的，和子宫并没有直接相连，所以无需切除。宫骶韧带（A错）、卵巢固有韧带（B错）、圆韧带（C错）、主韧带（D错）都是和子宫直接相连的，子宫全切时，必须切除。